视物旋转动荡，如在舟车之上，称为
A. 目昏
B. 目痒
C. 目眩
D. 雀盲
E. 内障

正确答案：C。目眩

解析：目昏是指视物昏暗，模糊不清的症状（A错）。目痒是指自觉眼睑、眦内或目珠瘙痒的症状，轻者揉拭则止，重者极痒难忍（B错）。目眩亦可称眼花，是指病人自觉视物旋转动荡，如坐舟车，或眼前如有蚊蝇飞动的症状（C对）。雀盲是指白昼视力正常，每至黄昏以后视力减退，视物不清的症状（D错）。内障是指患者自觉眼前蚊蝇飞舞，黑花飘荡，观灯火如彩虹环绕，视物昏蒙，夜盲，甚则暴盲等（E错）。